下列符合卫生法的形式之一是
A. 临床路径
B. 临床实践指南
C. 卫生法规
D. 卫生标准
E. 专家共识

正确答案：C。卫生法规

解析：卫生法规符合卫生法的形式（C对）。